对放射治疗和化疗均高度敏感的肿瘤是
A. 恶性淋巴瘤
B. 鳞状细胞癌
C. 基底细胞癌
D. 骨肉瘤
E. 鼻咽癌

正确答案：A。恶性淋巴瘤

解析：恶性淋巴瘤对放射治疗和化学药物治疗都比较敏感。掌握“恶性淋巴瘤”知识点。